组成骨性鼻中隔的骨有
A. 鼻骨和筛骨
B. 犁骨和筛骨
C. 额骨和犁骨
D. 泪骨和筛骨
E. 蝶骨和筛骨

正确答案：B。犁骨和筛骨

解析：犁骨和筛骨垂直板构成的骨性鼻中隔（B对）。